治疗月经过少痰湿证，应首选
A. 滋血汤
B. 归肾丸
C. 桃红四物汤
D. 乌药汤
E. 苍附导痰丸

正确答案：E。苍附导痰丸

解析：痰湿内停，阻滞经络，气血运行不畅，发为月经过少，治疗当化痰燥湿调经，苍附导痰丸的功效为燥湿健脾，化痰调经，为月经过少痰湿证的首选（E对）。滋血汤的功效为养血调经，治疗血虚证（A错）。归肾丸的功效为补肾养肝，益精养血，治疗肾虚证（B错）桃红四物汤的功效为养血活血，治疗血瘀证（C错）。乌药汤的功效为行气活血调经，治疗气滞证之月经后期（D错）。